李某，男，60岁。胸骨后剧烈疼痛两小时，伴大汗、面色苍白。应首选的检查方法是
A. 拍胸正位片
B. 心电图
C. 双肺CT
D. 超声心动图
E. 血常规

正确答案：B。心电图

解析：患者为老年男性，胸骨后剧烈疼痛两小时（为心肌梗死的典型临床表现），伴大汗、面色苍白，考虑诊断为急性心肌梗死。首选的检查是心电图（B对），心电图的特征性改变为新出现Q波及ST段抬高和ST-T动态演变。拍胸正位片（A错）可以看到心脏的大小，纵膈及肺脏有无占位性病变，对急性心肌梗死的诊断无帮助。双肺CT（C错）对于纵膈及肺脏有无占位性病变较胸部X线片更有诊断价值，且可以提供横断面的图像。超声心动图（D错）是应用超声波回声探查心脏和大血管以获取有关信息的一组无创性检查方法。血常规（E错）为一般性的检查方法，若有贫血可有红细胞减少，若有感染则有白细胞增多。